足月女婴，自然分娩，出生体重3Kg，娩出时Apgar评分4分，抢救10分钟后评9分。生后2小时出现凝视哭声单调，继而全身抽搐，肌张力偏高，为控制惊厥，应首先采用
A. 肌注呋塞米（速尿）3mg
B. 肌注地塞米松1.5mg
C. 20%甘露醇10ml静脉推注
D. 苯巴比妥钠60mg15～30分钟内静滴
E. 肌注维生素K₁1mg

正确答案：D。苯巴比妥钠60mg15～30分钟内静滴

解析：新生儿控制惊厥，首先苯巴比妥钠60mg15-30分钟内静滴（D对）。呋塞米（A错）和甘露醇（C错）一般用于脑水肿的治疗。糖皮质激素（地塞米松）一般用于免疫病、哮喘等的治疗，不用于控制惊厥（B错）。肌注维生素K1的治疗方法一般用于维生素K缺乏性出血的治疗，对治疗惊厥不起作用（E错）。